指导医生根据脏腑经络的病变部位而选用药物的理论是
A. 五味
B. 归经
C. 四气
D. 升降浮沉
E. 有毒与无毒

正确答案：B。归经

解析：本题考查的是归经的含义。指导医生根据脏腑经络的病变部位而选用药物的理论是归经（B对）。归经：归，即归属，指药物作用的归属；经，即人体的脏腑经络。归经，即药物作用的定位。就是把药物的作用与人体的脏腑经络密切联系起来，以说明药物作用对机体某部分的选择性，从而为临床辨证用药提供依据。五味（A错）：即指药物因功效不同而具有辛、甘、酸、苦、咸等味。其既是药物作用规律的高度概括，又是部分药物真实滋味的具体表示。四气（C错）：又称四性。即指药物具有的寒、热、温、凉四种药性。它反映药物影响人体阴阳盛衰和寒热变化的作用特点，是说明药物作用性质的重要概念之一。升降浮沉（D错）：即指药物在人体的作用趋向。这种趋向与所疗疾患的病势趋向相反，与所疗疾患的病位相同。是说明药物作用性质的概念之一。有毒与无毒（E错）：从狭义上讲，是指药物用于人体后能否造成伤害而言。从广义上讲，除指药物的作用能否对人体造成伤害外，还应包括药物对人体治疗作用的强弱。也就是说，药物的有毒与无毒反映了其偏性对人体的两面性。一般说，药物的有毒与无毒和“毒”的大小，与其对人体伤害程度的轻重及治疗作用的强弱成正比。